输尿管是将肾产生的尿液输送至膀胱的肌性管道，行程较长约20~30cm，在腹膜后下行，入盆腔注入膀胱。在女性与子宫动脉相交叉。输尿管
A. 全程行于腰大肌前面
B. 属腹膜外位器官
C. 分为腹、盆两部
D. 在女性经子宫动脉前上方达膀胱
E. 属腹膜间位器官

正确答案：B。属腹膜外位器官

解析：输尿管为腹膜外位器官（E错,B对），分为腹部、盆部和壁内部（C错），其中只有腹部行于腰大肌前面（A错），而在盆部，女性输尿管经子宫动脉后下方达膀胱（D错）。